在肝炎患者中，最能反映病情严重程度的实验室血清学检查项目是
A. 谷丙转氨酶
B. 谷草转氨酶
C. 凝血酶原活动度
D. 血清胆碱酯酶
E. R—氨酸转肽酶

正确答案：C。凝血酶原活动度

解析：凝血酶原活动度（C对）是凝血酶原测定值的常用表示方法，对判断疾病进展及预后有较大价值，近期内凝血酶原活动度进行性降至40%以下为肝衰竭的重要诊断标准之一，小于20%者提示预后不良；谷丙转氨酶（A错）和谷草转氨酶（B错）是反应肝细胞损伤的敏感指标，其中谷丙转氨酶对肝病诊断的特异性比谷草转氨酶高，是反映肝细胞损伤最敏感最常用的指标；血清胆碱酯酶（D错）可反映肝脏合成功能，对了解病情轻重和检测肝病发展有参考价值；R—氨酸转肽酶（E错）提示肝内合成亢进或胆汁排出受阻。